慢性盘状红斑狼疮的病理变化不包括
A. 上皮表面角化，可见角质栓塞
B. 上皮基底细胞液化
C. 上皮下血管扩张，可见玻璃样血栓
D. 上皮下血管周有中性粒细胞浸润
E. 上皮下血管周围有类纤维蛋白沉积

正确答案：D。上皮下血管周有中性粒细胞浸润

解析：慢性盘状红斑狼疮的病理变化包括:上皮表面有过度角化，多为过度正角化。粒层明显，角化层可有剥脱，有时可见角质栓塞；棘层萎缩变薄，有时可见上皮钉突增生、伸长；基底细胞发生液化变性，上皮与固有层之间可形成裂隙和小水疱，基底膜不清晰；上皮下结缔组织内有淋巴细胞浸润，毛细血管扩张，管壁不整，血管内可见玻璃样血栓，血管周围有PAS阳性类纤维蛋白沉积，管周有淋巴细胞浸润；胶原纤维发生类纤维蛋白变性，纤维水肿、断裂；基底膜可增厚。上述病理变化不一定同时存在。掌握“口腔扁平苔藓与慢性盘状红斑狼疮”知识点。